克罗恩病的最常见并发症是
A. 中毒性休克
B. 结肠大出血
C. 肠梗阻
D. 急性肠穿孔
E. 癌变

正确答案：C。肠梗阻

解析：克罗恩病最常见的并发症是肠梗阻（C对），其次是腹腔内脓肿，偶可并发急性肠穿孔（D错）或结肠大出血（B错）。直肠或结肠黏膜受累者可发生癌变（E错）。中毒性休克（A错）可见于溃疡性结肠炎，不是克罗恩病的常见并发症。